形成血浆胶体渗透压的主要物质是
A. NaCl
B. 白蛋白
C. 球蛋白
D. 纤维蛋白
E. 血红蛋白

正确答案：B。白蛋白

解析：溶液渗透压高低取决于溶液中溶质颗粒（分子或离子）数目的多少，而与溶质的种类和颗粒大小无关。由晶体物质所形成的渗透压称为晶体渗透压，约80%来自Na⁺和Cl⁻（A错）。由血浆蛋白质所形成的渗透压为血浆胶体渗透压，血浆蛋白包括白蛋白、球蛋白和纤维蛋白原（P55）三类，而血红蛋白（E错）主要存在于红细胞中。在血浆蛋白中，白蛋白的分子量小，其分子数量远多于球蛋白（C错）和纤维蛋白原（D错），故形成血浆胶体渗透压的主要物质是白蛋白（B对）。